关于药典及药品标准的叙述，错误的是
A. 我国药品标准有中国药典和局（部）颁标准
B. 药品标准是药品生产、供应、使用、检验和管理的法定依据
C. 《新修本草》是世界上最早的一部全国性药典
D. U.S.P和B.P分别为美国和英国药典的英文缩写
E. 已颁布施行的中国药典均分为一、二两部

正确答案：E。已颁布施行的中国药典均分为一、二两部